男，20岁。左腰部被刺后伤口持续溢出淡红色液体2小时。查体：P110次／分，BP95/70mmHg。左上腹有压痛，无肌紧张及反跳痛。诊断首先应考虑
A. 脾破裂
B. 胰腺损伤
C. 肝破裂
D. 胃穿孔
E. 肾损伤

正确答案：E。肾损伤

解析：患者青年男性，左腰部（肾区）被刺后伤口持续溢出淡红色液体2小时，查体：P110次／分（正常60-100次/分），BP95/70mmHg（正常90-120/60-90mmHg）。左上腹有压痛，无肌紧张及反跳痛（无腹膜刺激征），说明刺伤未伤及脾脏（A错）、胃（D错）、肠、胰腺（B错）等脏器。肝脏（C错）大部分位于腹右侧，左腰部受伤一般不伤及肝脏。因此，诊断应先考虑肾损伤（E对）。